当药物疗效和不良反应与血药浓度的相关程度明显大于其与剂量的相关程度时，可利用治疗药物监测（TDM）来调整剂量，使给药方案个体化。下列需要进行TDM的有
A. 阿托伐他汀钙治疗高脂血症
B. 苯妥英钠治疗癫痫
C. 地高辛治疗心功能不全
D. 罗格列酮治疗糖尿病
E. 氨氯地平治疗高血压

正确答案：B、C。苯妥英钠治疗癫痫；地高辛治疗心功能不全

解析：本题考查治疗药物监测。需要进行TDM的有苯妥英钠治疗癫痫（B对）、地高辛治疗心功能不全（C对）。治疗药物监测的适用范围：（1）个体差异很大的药物，如三环类抗抑郁药；（2）具非线性动力学特征的药物，如苯妥英钠；（3）治疗指数小、毒性反应强的药物，如强心苷类药；（4）毒性反应不易识别、用量不当或用量不足的临床反应难以识别的药物，如用地高辛控制心律失常；（5）特殊人群用药；（6）常规剂量下没有疗效或出现毒性反应的药物；（7）合并用药出现异常反应；（8）血药浓度因长期用药可能受到各种因素的影响而发生变化；（9）用于诊断和处理药物过量或中毒。